对白斑作出诊断可依据
A. 可根据临床检查做出
B. 可根据血液化验获得
C. 可根据家族病史确认
D. 必须有病理检查证实
E. 必须由间接免疫荧光检查做出

正确答案：D。必须有病理检查证实

解析：本题考查白斑的诊断。对白斑作出诊断可依据必须有病理检查证实（D对）。口腔白斑病的诊断需根据临床表现和病理表现作出综合性判断才能完成，其诊断的确定性（C），可分为以下四个级别：（1）C1：暂时性临床诊断，根据临床初诊检查证据，排除其他可定义的疾病或损害；（2）C2：肯定性临床诊断，去除可能的致病因子2～4周后损害无改善；（3）C3：切取组织病理证实诊断，在C2基础上，结合切取组织病理检查未发现其他可定义病损，表现为口腔白斑病的损害特征；（4）C4：切除组织病理证实诊断，外科切除所有临床可见损害，并通过组织病理检查作出的诊断。